下述哪个结构与左眼鼻侧视野的视觉传导有关
A. 视交叉中部
B. 右侧视束
C. 右侧内侧膝状体
D. 左侧视辐射
E. 左侧颞横回

正确答案：D。左侧视辐射

解析：视觉传导通路由三级神经元组成。第一级神经元为视网膜内的双极细胞。第二级神经元为视网膜内的节细胞，由节细胞发出的轴突形成视神经，经视神经管进入颅腔。在视交叉处，来自两眼视网膜颞侧半的纤维左右交叉，两眼鼻侧半交叉后的纤维和颞侧半不交叉的纤维形成左、右视束，止于第三级神经元即外侧膝状体。然后发出纤维组成视辐射，经内囊后肢投射至距状沟周围皮质。左眼鼻侧视野的视觉传导由颞侧半视神经纤维传导，由于其纤维不交叉，所以仍由左侧视辐射（D对）传导。